患者，男，41岁，BMI30.2kg/m²，因上腹胀1年就诊，常年饮酒（酒精量100g/d）。腹部B超显示：脂肪肝。生化检查：ALT100U/L，AST210U/L，γ-GGT130U/L，TG3.3mmol/L，血糖正常，肝炎病毒相关检查（-），关于该患者疾病管理的说法，错误的是
A. 定期复查肝功能和腹部B超
B. 高蛋白、低脂饮食
C. 减轻体重
D. 使用依折麦布调节血脂
E. 戒酒

正确答案：D。使用依折麦布调节血脂

解析：本题考查血脂异常的患者教育。依折麦布主要降低胆固醇，不是调节血脂（D错，为本题正确答案）。该患者属于肥胖，脂肪肝，肝功能ALT，AST偏高，TG偏高，血糖正常，无感染肝炎病毒。因此应定期复查肝功能和腹部B超（A对），高蛋白低脂饮食（B对）。肥胖是血脂代谢异常的重要危险因素。超重或肥胖者应控制体重增长，并争取逐渐减少体重至理想状态（C对）。饮酒对于心血管事件的影响尚无确切证据，但提倡限制饮酒（E对）。